男性，34岁，突然寒战高热，咳嗽，两周后咳大量脓臭痰。查体：右肺背侧肩胛下部可闻湿性啰音，WBC21×10⁹/L，中性粒细胞0.88。为了正确使用抗生素要进一步做下述哪项检查
A. 肝功能检查
B. 肾功能检查
C. 尿常规
D. 痰细菌培养及药敏
E. 血钾、钠、氯测定

正确答案：D。痰细菌培养及药敏

解析：青年患者高热、咳嗽咳痰两周后咳大量脓臭痰，感染中毒症状重，且右肺背侧肩胛下部可闻湿性啰音，考虑为肺脓肿。为了正确使用抗生素要进一步做痰细菌培养及药敏（D对）。